男性，37岁，急刹车致使方向盘挤压上腹部16小时，上腹部腰部及右肩疼痛，持续性，伴恶心呕吐。查体：体温38.4℃，上腹部肌紧张明显，有压痛，反跳痛不明显，无移动性浊音，肠鸣音存在，怀疑胰腺损伤。胰腺损伤在各种腹部损伤中所占比例为
A. 1%～2%
B. 5%～10%
C. 16%～20%
D. 25%～35%
E. 40%～50%

正确答案：A。1%～2%

解析：胰腺由于解剖位置较深，损伤发生率较低。胰腺损伤约占腹部损伤的1%～2%（A对），常由上腹部强力挤压伤（如自行车把伤、方向盘伤）所致。脾脏损伤为腹部损伤中最常见的脏器损伤，占腹部损伤的40%～50%（E错）；肝脏损伤占腹部损伤的20%～30%。